泼尼松可治疗的疾病是
A. 高血压
B. 心律不齐
C. 风湿性及类风湿性关节炎
D. 骨质疏松
E. 粒细胞增多症

正确答案：C。风湿性及类风湿性关节炎

解析：本题考查泼尼松的作用。泼尼松可治疗的疾病是风湿性及类风湿性关节炎（C对）。泼尼松属于糖皮质激素，可用于自身免疫性疾病，如风湿热、风湿性心肌炎、风湿性及类风湿性关节炎、全身性红斑狼疮、结节性动脉周围炎、皮肌炎、自身免疫性贫血和肾病综合征等。一般采用综合疗法，不宜单用，以免引起不良反应。